后牙近中面颈部洞是Black分类的
A. Ⅱ类洞
B. Ⅲ类洞
C. Ⅰ类洞
D. Ⅴ类洞

正确答案：A。Ⅱ类洞

解析：本题考查Black分类法。后牙近中面颈部洞是Black分类的Ⅱ类洞（A对）。Ⅰ类洞：所有牙面发育点隙裂沟的龋损所备成的窝洞（C错）。Ⅱ类洞：后牙邻面的龋损所备的窝洞，其中包括磨牙及前磨牙的邻面洞。Ⅲ类洞：前牙邻面未累及切角的龋损所备成的窝洞（B错）。Ⅳ类洞：前牙邻面累及切角的龋损所备成的窝洞。Ⅴ类洞：所有牙齿颊（唇）舌面颈1/3处的龋损所备成的窝洞（D错）。